诸暴强直，皆属于
A. 火
B. 心
C. 风
D. 寒
E. 湿

正确答案：C。风

解析：诸暴强直，皆属于风（C对）。诸热瞀瘈，皆属于火；诸禁鼓慄，如丧神守，皆属于火；诸逆冲上，皆属于火；躁狂越，皆属于火；诸病胕肿，痛酸惊骇，皆属于火（A错）。诸痛痒疮，皆属于心（B错）。诸病水液，澄澈清冷，皆属于寒（D错）。诸痉项强，皆属于湿（E错）。